正常成年女性血细胞比容是
A. 20%～35%
B. 37%～48%
C. 40%～50%
D. 50%～60%
E. 60%～70%

正确答案：B。37%～48%